仅接受对侧皮质核束纤维
A. 舌下神经核
B. 动眼神经核
C. 滑车神经核
D. 面神经核
E. 展神经核

正确答案：A。舌下神经核

解析：因为面神经核下部和舌下神经核只接受单侧（对侧）皮质核束支配，所以只接受对侧皮质核束的脑神经核为面神经核下部、舌下神经核（A对）。